在气雾剂的处方中，可作为乳化剂的辅料是
A. F12
B. 丙二醇
C. 吐温80
D. 蜂蜡
E. 维生素C

正确答案：C。吐温80

解析：本题考查气雾剂的附加剂。乳剂型气雾剂中的药物若不溶于水或在水中不稳定时，可将药物溶于甘油、丙二醇类溶剂中，加入抛射剂，还需加入适当的乳化剂，如司盘类和吐温类（C对）。F12（A错）作抛射剂。丙二醇（B错）作潜溶剂。蜂蜡（D错）可作为软膏剂的油脂性基质。维生素C（E错）可作为液体制剂的水溶性抗氧剂。